痣细胞同时存在于上皮和结缔组织内，称为
A. 交界痣
B. 皮内痣
C. 黏膜内痣
D. 复合痣
E. 复杂痣

正确答案：D。复合痣

解析：复合痣的痣细胞同时存在于上皮和结缔组织内。交界痣的痣细胞局限于上皮-结缔组织交界区。皮内痣或黏膜内痣的痣细胞位于结缔组织内。掌握“口腔黏膜色素痣”知识点。